颈淋巴清扫术、下颌骨切除术、腮腺摘除术的最佳的引流方法是
A. 负压引流
B. 油纱条引流
C. 片状引流
D. 管状引流
E. 碘仿纱条引流

正确答案：A。负压引流

解析：负压引流：利用细塑料管或橡皮管在创口旁另戳创引出，接于吸引器、吸引球或胃肠减压器上，使创口产生负压，从而达到负压吸引的引流目的。此引流法优点较多，具有较强的引流作用，而且不需加压包扎伤口，患者感觉舒适；因创口内是负压，组织间贴合紧密，利于创口愈合，也不易继发感染。主要用于颌面颈部较大手术的术后引流，例如颈淋巴清扫术、下颌骨切除术、腮腺摘除术等。掌握“口外手术打结、缝合及外科引流”知识点。